出入肾门的结构有
A. 肾血管
B. 肾盂
C. 淋巴管
D. 神经
E. 以上都是

正确答案：E。以上都是

解析：出入肾门的结构有肾的血管（A对）、神经（D对）、淋巴管（C对）及肾盂出入（D对，故E为本题正确答案）。